以下哪种病理改变多见于天疱疮
A. 黏膜下纤维化
B. 基底细胞液化
C. 基底细胞空泡性变
D. 上皮异常增生
E. 棘层松解

正确答案：E。棘层松解

解析：棘层松解是由于上皮棘层细胞间张力原纤维及黏合物质发生变性、断裂破坏，细胞间桥溶解，而使棘细胞间联系力松弛、断裂，严重时失去联系、解离，在棘层形成裂隙或疱。此种病变见于天疱疮等。掌握“口腔黏膜基本病理变化”知识点。